心室肌细胞有效不应期相当于
A. 收缩期
B. 舒张期
C. 收缩期+舒张早期
D. 收缩期+舒张期
E. 舒张晚期

正确答案：C。收缩期+舒张早期

解析：心肌细胞兴奋性的周期变化：有效不应期（绝对不应期+局部反应期）→相对不应期→超常期。与骨骼肌细胞和神经细胞比，心室肌的有效不应期特别长，一直延续到心肌收缩活动的舒张早期，所以，心室肌有效不应期相当于收缩期+舒张早期（C对），使心肌不会发生完全强直收缩，从而保证心脏泵血活动的正常进行。